患者，女，67岁，入院后行左侧髋关节置换术，术前12小时皮下注射低分子肝素预防深静脉血栓。术后患者情况稳定，继续使用低分子肝素，住院第7天出院。和普通肝素相比，关于低分子肝素作用特点的说法，错误的是
A. 起效更快
B. 剂量和抗凝效果的相关性更好，不易引起出血
C. 可以固定剂量给药，一般不需要进行凝血功能监测
D. 发生肝素诱导的血小板减少症的风险较低
E. 作用维持时间更长

正确答案：A。起效更快

解析：本题考查低分子肝素作用特点。低分子肝素起效略慢（A错，为本题正确答案）。低分子肝素作用特点：（1）皮下给药时，生物利用度高于普通肝素。（2）抗凝作用持续时间较长，因此可以一日仅给药1次或2次，且可在门诊给药。（3）剂量和抗凝效果的相关性更好，不易引起出血（B对），可以固定剂量给药，一般不需要进行凝血功能监测（C对）。（4）发生肝素诱导的血小板减少症的风险较低（D对）。（5）骨质疏松发生率较低。（6）与普通肝素相比，低分子肝素给药相对容易且不会通过胎盘，因此其为妊娠期首选的抗凝药。（7）起效略慢（例如，20～30min），不如静脉快速给予普通肝素那样立即起效。（8）作用持续时间较长（E对），更难以快速终止治疗。